患儿，4岁。两天前出现腹痛，证见脘腹胀满，疼痛拒按，不思乳食，矢气频作，腹痛欲泻，泻后痛减，粪便秽臭，夜卧不安，舌质淡红，苔厚腻，脉象沉滑。其证型是
A. 脾胃虚寒
B. 气滞血瘀
C. 乳食积滞
D. 腹部中寒
E. 胃肠积热

正确答案：C。乳食积滞

解析：乳食积滞证症状：脘腹胀满，疼痛拒按，不思乳食，嗳腐吞酸，或时有呕吐，吐物酸馊，或腹痛欲泻。泻后痛减，矢气频作，大便秽臭。夜卧不安，时时啼哭，舌淡红，苔厚腻，脉象沉滑，或指纹紫滞。治法：消食导滞，行气正痛。方药：香砂平胃散加减（C对）。脾胃虚寒症候腹痛绵绵，时作时止，痛处喜温喜按，面白少华，精神倦怠，手足不温，乳食减少，或食后腹胀，大便稀溏，唇舌淡白，脉沉缓，或指纹淡红。治法：温中理脾，缓急止痛。方药：小建中汤合理中丸加减（A错）。气滞血瘀证候：腹痛经久不愈，痛有定处，痛如锥刺，舌紫暗或有瘀点，脉涩，或指纹紫滞。治法：活血化瘀，行气止痛。方药：少腹逐瘀汤加减（B错）。腹部中寒证候腹部疼痛，阵阵发作，得温则舒，遇寒痛甚，肠鸣辘辘，面色苍白，痛甚者，额冷汗出，唇色紫暗，肢冷，或兼吐泻，小便清长，舌淡红，苔白滑，脉沉弦紧，或指纹红。治法：温中散寒，理气止痛。方药：养脏散加减（D错）。胃肠积热证候腹部胀满，疼痛拒按，大便秘结，烦躁不安，烦热口渴，手足心热，唇舌鲜红，舌苔黄燥，脉滑数或沉实，或指纹紫滞。治法：通腑泄热，行气止痛。方药：小承气汤加减（E错）。